低血糖不良反应较大的药物是
A. 磺酰脲类药物
B. 格列奈类药物
C. 格列酮类药物
D. 糖苷酶抑制剂
E. 短效胰岛素

正确答案：A。磺酰脲类药物

解析：磺酰脲类药物（A对）属于胰岛素促分泌剂，刺激胰岛B细胞释放胰岛素，若药物使用过量，可造成高胰岛素血症，产生严重的低血糖血症。格列奈类药物（B错）（P354）主要不良反应为低血糖反应，但发生率较磺酰脲类低。格列酮类药物（C错）（P354）不良反应少，低血糖发生率低。糖苷酶抑制剂（D错）（P355）主要不良反应是胃肠道反应。短效胰岛素（E错）较少出现低血糖，长效胰岛素若使用过量，可发生低血糖症。